关于恶露的特点，正确的是
A. 白色恶露含少量胎膜
B. 浆液恶露持续3天
C. 正常恶露持续4～6周
D. 血性恶露持续7天
E. 血性恶露含有蜕膜和细菌

正确答案：C。正常恶露持续4～6周

解析：产后随子宫蜕膜脱落，含有血液、坏死蜕膜等组织经阴道排出，称为恶露。正常恶露有血腥味，无臭味，可持续4～6周（C对）。因其颜色、内容物及时间不同，恶露分为血性恶露、浆液恶露及白色恶露。血性恶露，因含大量血液得名，含有大量红细胞、坏死蜕膜及少量胎膜（E错），可持续3～4日（D错）。浆液恶露，因含多量浆液得名，含有较多坏死蜕膜组织、宫腔渗出液及宫颈粘液，可持续10日（B错）。白色恶露，因含大量白细胞，色泽较白得名，含有大量白细胞、坏死蜕膜组织、表皮细胞及细菌（A错），持续3周。